气闭或气脱的病机，主要是指
A. 元气耗损，脏腑功能减退，抗病力下降
B. 气机不畅，流通受阻，脏腑经络功能障碍
C. 气机升降失常，脏腑之气逆上
D. 气虚无力升举，脏腑位置下垂
E. 气的出入异常，或闭阻，或外散

正确答案：E。气的出入异常，或闭阻，或外散

解析：气闭是气闭于体内不能外出，气脱是气不能存于体内，向外丢失（E对）。元气耗损，脏腑功能减退，抗病力下降是气虚的病机（A错）。气机不畅，流通受阻，脏腑经络功能障碍是气滞的病机（B错）。气机升降失常，脏腑之气逆上是气逆的病机（C错）。气虚无力升举，脏腑位置下垂是气陷的病机（D错）。